属短骨
A. 跟骨
B. 跖骨
C. 指骨
D. 髋骨
E. 椎骨

正确答案：A。跟骨

解析：跟骨属短骨（A对）。髋骨（D错）、椎骨属于不规则骨（E错）。